关于免疫耐受，错误的是
A. 多次注射耐受原可延长免疫耐受状态
B. 静脉注射抗原易诱导免疫耐受
C. 聚合的蛋白抗原易诱导免疫耐受
D. 遗传背景与免疫耐受相关
E. 克隆清除是形成免疫耐受的机制之一

正确答案：C。聚合的蛋白抗原易诱导免疫耐受